通过产生NO，减少细胞Ca²⁺浓度的药物是
A. 奎尼丁
B. 硝酸甘油
C. 地高辛
D. 卡托普利
E. 硝苯地平

正确答案：B。硝酸甘油

解析：本题考查硝酸甘油。硝酸甘油（B对）进入平滑肌细胞内产生N0，N0激活鸟苷酸环化酶，增加胞内cGMP含量，降低胞浆中Ca²⁺浓度。奎尼丁（A错）为钠通道阻滞剂。地高辛（C错）能够抑制心肌细胞膜Na⁺，K⁺-ATP酶，使细胞内Na⁺水平升高，促进Na⁺-Ca²⁺交换，提高细胞内Ca²⁺水平，从而发挥正性肌力作用。卡托普利（D错）有排钠作用，使细胞内Na⁺水平降低，Na⁺-Ca²⁺交换减弱，降低细胞内Ca²⁺水平。硝苯地平（E错）为钙通道阻滞药，能够阻止胞浆Ca²⁺浓度升高。